外伤性腹膜后巨大血肿易发生
A. 机械性肠梗阻
B. 单纯性肠梗阻
C. 麻痹性肠梗阻
D. 痉挛性肠梗阻
E. 绞窄性肠梗阻

正确答案：C。麻痹性肠梗阻

解析：外伤性腹膜后血肿多由腹膜后脏器损伤、骨盆或下段脊柱骨折和腹膜后血管损伤引起。巨大的腹膜后血肿可刺激、压迫腹腔内神经或神经丛，引起肠蠕动减弱从而导致麻痹性肠梗阻（C对）。麻痹性肠梗阻和痉挛性肠梗阻均为动力性肠梗阻，是由于神经抑制或毒素刺激以致肠壁肌运动紊乱，但无器质性肠腔狭窄。痉挛性肠梗阻（D错）较少见，可见于急性肠炎、肠道功能紊乱或慢性铅中毒病人。机械性肠梗阻（A错）指机械性因素致肠腔狭小或不通，使肠内容物不能通过，是临床上最常见的类型，多由于术后或慢性炎症导致的肠粘连、肿瘤压迫、肠套叠、肠道寄生虫病等因素所致。单纯性肠梗阻（B错）指仅有肠内容物通过受阻，而无肠管血运障碍的肠梗阻；麻痹性肠梗阻的肠管无血运障碍，应属单纯性肠梗阻，因此B选项也正确。绞窄性肠梗阻（E错）指肠管发生血运障碍的肠梗阻，可有肠坏死、穿孔，外伤性硬膜外血肿不会引起肠管血运障碍。